可导致人体内生物转化能力下降的主要因素为
A. 高脂肪饮食
B. 轻度肥胖
C. 高糖饮食
D. 肝功能下降
E. 心肌缺血

正确答案：D。肝功能下降

解析：因为肝是机体内生物转化最重要的器官，故可导致人体内生物转化能力下降的主要因素为肝功能下降（D对）。高脂肪饮食（A错）、轻度肥胖（B错）、高糖饮食（C错）都可对肝功能造成一定影响，故也导致人体内生物转化能力下降，但不是主要因素。心肌缺血一般情况下不会导致人体内生物转化能力下降（E错）。